下列关于翼颌间隙交通的叙述中，正确的是
A. 向上与颞下间隙及颞间隙通连
B. 向前通颊间隙
C. 向下与舌下、下颌下间隙相通
D. 向后与咽旁间隙相通
E. 以上均正确

正确答案：E。以上均正确

解析：翼下颌间隙向上与颞下间隙及颞间隙通连，向前通颊间隙，向下与舌下、下颌下间隙相通，向后与咽旁间隙相通，向外通咬肌间隙。尚可经颅底血管神经通颅内。掌握“面侧深区及颌面部各间隙的境界”知识点。